铸造3/4冠与铸造全冠比较，其优点是
A. 牙冠的边缘显露金属
B. 边缘线长
C. 磨除的牙体组织较少
D. 必须作邻轴沟
E. 固位力强

正确答案：C。磨除的牙体组织较少

解析：全冠与3/4冠的最本质区别就是牙体预备时磨除牙体组织量不一样。掌握“部分冠”知识点。